下列激素中，属于下丘脑调节肽的是
A. 促甲状腺激素
B. 促肾上腺皮质激素
C. 促性腺激素
D. 生长抑素
E. 促黑素细胞激素

正确答案：D。生长抑素